小儿重症肺炎最常见的酸碱平衡紊乱是
A. 呼吸性酸中毒
B. 代谢性酸中毒
C. 呼吸性碱中毒
D. 代谢性碱中毒
E. 混合性酸中毒

正确答案：E。混合性酸中毒

解析：小儿重症肺炎有严重的缺氧及毒血症，可出现呼吸衰竭。首先严重缺氧时，体内需氧代谢发生障碍，无氧酵解增强，酸性代谢产物增加，加上高热、进食少、脂肪分解等因素，常引起代谢性酸中毒；同时由于二氧化碳排出受阻，可产生呼吸性酸中毒；因此，严重者存在不同程度的混合性酸中毒，故小儿重症肺炎最常见的酸碱平衡紊乱是混合性酸中毒（E对AB错）。呼吸性碱中毒（C错）可出现于呼吸代偿功能稍强，通过加深加快呼吸，加快排出二氧化碳而产生。代谢性碱中毒（D错）常发生于体内酸丢失过多或体外摄入过多的碱性药物等。